单个引起的毛囊及其附件的急性化脓性炎症称
A. 疖
B. 痈
C. 脓肿
D. 丹毒
E. 冷脓肿

正确答案：A。疖

解析：面部皮肤是人体毛囊及皮脂腺、汗腺最丰富的部位之一，又是人体暴露部分，接触外界尘土、污物、细菌机会多，也易招致损伤，因此而引起的毛囊及其附件的急性化脓性炎症称疖，其病变局限于皮肤浅层组织。掌握“面部疖痈”知识点。